在给予实验动物苯硫磷后，发现马拉硫磷的毒性明显增强，说明该物质抑制
A. 醇脱氢酶
B. 酯酶
C. 黄素加单氧酶
D. 单胺氧化酶
E. 环氧化物水化酶

正确答案：B。酯酶